下列哪项不属辨咳嗽寒热性质的依据
A. 痰的有无
B. 痰质稀稠
C. 咳嗽声音
D. 体质状况
E. 痰色

正确答案：D。体质状况

解析：咳声重浊沉闷，多属实证，多因寒痰湿浊停聚于肺，肺失肃降所致。咳声轻清低微，多属虚证，多因久病耗伤肺气，失于宣降所致。咳声重浊，痰白清晰，鼻塞不通，多因风寒袭肺，肺失宣降所致。咳嗽声高响亮，痰稠色黄，不易咯出，多属热证，多因热邪犯肺，灼伤肺津所致。咳嗽痰多，易于咯出，多因痰浊阻肺所致。干咳无痰或痰少而黏，不易咯出，多属燥邪犯肺或阴虚肺燥所致。体质状况的不同会使患者易于患什么样的咳嗽，但咳嗽的辩证依据没有体质因素（D错，为本题正确答案）